男，48岁。呕血5小时入院。查体：P120次/分，BP80/55mmHg。神智不清，营养状况差。巩膜明显黄染，腹壁可见静脉曲张，肝肋下可触及，质地较硬，边缘较钝，脾肋下6cm，移动性浊音阳性，肠鸣音弱。该病人呕血最可能的原因是
A. 胆石症所致胆道出血
B. 消化性溃疡出血
C. 食管胃底曲张静脉破裂
D. 晚期胃癌出血
E. 胆管肿瘤所致胆道出血

正确答案：C。食管胃底曲张静脉破裂

解析：中年男性患者，呕血5小时入院（提示消化道出血）。查体：P120次/分（正常值为60～100次/分），BP80/55mmHg（正常值为90～120/60～90mmHg，提示休克）。神智不清（有神经系统症状），营养状况差。巩膜明显黄染，腹壁可见静脉曲张，肝肋下可触及，质地较硬，边缘较钝，脾肋下6cm，移动性浊音阳性，肠鸣音弱（肝硬化失代偿期的典型表现）。食管胃底静脉曲张破裂出血为最常见的并发症。综合该病人的病史、体查，该病人呕血最可能的原因是食管胃底曲张静脉破裂（C对）。胆石症所致胆道出血（九版外科学P449）（A错）常有胆石症的特殊病史：在饱餐、进食油腻食物后或睡眠中体位改变时，发生胆绞痛，墨菲氏征阳性等，且胆道出血常为周期性出血，每隔1～2周发作一次，多反复发作。消化性溃疡出血（B错）应有慢性病程、周期性发作的节律性上腹疼痛的特殊病史，一般无肝脾肿大、皮肤巩膜黄染等，胃镜检查可以确诊。晚期胃癌出血（D错）主要是原发性胃癌的表现如上腹痛、餐后加重、纳差、厌食、乏力及体重减轻等。胆管肿瘤所致胆道出血（九版诊断学P31）（E错）主要表现为黄疸、寒战、发热伴右上腹绞痛。